中医儿科首创五脏辨证医家是
A. 刘昉
B. 万全
C. 曾世荣
D. 钱乙
E. 夏禹铸

正确答案：D。钱乙

解析：在张仲景辨证论治思想的影响下，钱乙首创小儿五脏辨证体系，提出心主惊、肝主风、脾主困、肺主喘、肾主虚的辨证纲领（D对）。南宋刘昉（A错）著《幼幼新书》，整理、汇集了宋代以前的儿科学术成就，是当时世界上内容最完备的儿科专著，成为后人研究宋代以前儿科文献的主要著作。万全（B错）著《幼科发挥》、《育婴秘诀》，系统提出了“阳常有余、阴常不足”，“肝常有余、脾常不足”，“心常有余、肺常不足”，“肾常虚”等观点，提出了“预养以培其元，胎养以保其真、蓐养以防其变、鞠养以慎其疾”的育婴四法。曾世荣（C错）编著《活幼口议》、《活幼心书》，将小儿病因、病机、诊治等编成七言四句歌诀，并加以注释，以便初学者理解和记诵；对惊风抽搐一证的辨证论治有独到见解，将急惊风归纳为四证八候，提出镇惊、截风、退热、化痰治法，立琥珀抱龙丸、镇惊丸等疗惊方，均沿用至今。夏禹铸（E错）著《幼科铁镜》，重视望面色，审苗窍，以辨脏腑寒热虚实；运用“灯火十三燋”，治疗脐风、惊风等证；重视推拿疗法在儿科的应用。